当牙冠发育完成时，牙根处的内釉上皮和外釉上皮在颈环处增生，这些增生的双层细胞称为
A. Malassez上皮剩余
B. Serre上皮剩余
C. 上皮隔
D. 上皮根鞘
E. 结合上皮

正确答案：D。上皮根鞘

解析：当牙冠发育即将完成时，牙根处的内釉上皮和外釉上皮在颈环处增生，向未来的根尖孔方向生长，这些增生的双层细胞称为上皮根鞘。掌握“牙体、牙周组织的形成”知识点。